男，50岁。呕血3小时。晚餐进食粗糙食物后突发呕鲜血，量约600ml。乙肝病史30年，曾有黑便史。查体：T36.5℃，P110次／分，R20次／分，BP110/70mmHg。皮肤未见出血点，可见肝掌。双肺呼吸音清，未闻及干湿性啰音，心律齐。腹软，无压痛，肝肋下未触及，脾肋下2cm。患者拟接受手术止血，最主要的处置是
A. 结扎切断胃底贲门周围血管
B. 结扎切断胃十二指肠血管
C. 结扎切断右及左胃网膜血管
D. 结扎切断胃左及胃右动脉
E. 缝合结扎食管旁曲张静脉

正确答案：A。结扎切断胃底贲门周围血管

解析：中年男性患者，呕血3小时。晚餐进食粗糙食物后突发呕鲜血，量约600ml。乙肝病史30年，曾有黑便史。皮肤未见出血点，可见肝掌（肝功能减退表现）。脾肋下2cm（肝硬化门静脉高压的表现）。综合患者的症状、体征和辅助检查，初步诊断为肝硬化。食管胃底静脉曲张的破裂出血是肝硬化门静脉高压所致出血的主要原因，患者拟接受手术止血，最主要的处置是结扎切断胃底贲门周围血管（A对）。结扎切断胃十二指肠血管（B错）、结扎切断右及左胃网膜血管（C错）、结扎切断胃左及胃右动脉（D错）、缝合结扎食管旁曲张静脉（E错）均不是手术止血最主要的处置。